前体药物，体内经肝脏代谢，分子中亚甲砜还原成甲硫基后才能产生生物活性的药物是
A. 吲哚美辛
B. 双氯芬酸钠
C. 舒林酸
D. 奈丁美酮
E. 芬布芬

正确答案：C。舒林酸

解析：本题考查舒林酸。舒林酸（C对）属前体药物，它在体外无效，在体内经肝代谢，结构中甲基亚砜基被还原成甲硫基化合物而显示生物活性。吲哚美辛（A错）和双氯芬酸钠（B错）为非前药。萘丁美酮（D错）为非酸性的前体药物，其本身无环氧合酶抑制活性。小肠吸收后，经肝脏首关代谢为活性代谢物，即原药6-甲氧基-2-萘乙酸起作用。芬布芬（E错）进入体内后代谢成为联苯乙酯后具有抑制环氧合酶的活性，但是结构中不含有亚砜基。